男，43岁。高血压病史3年，血压测量140～150/90～95mmHg。化验结果血钙3.2mmol/L，血钾5.0mmol/L，血肌酐100μmol/L，血糖6.1mmol/L，血低密度脂蛋白2.3mmol/L。该患者目前不宜使用噻嗪类利尿剂降压的主要原因是
A. 促进远曲小管由甲状旁腺激素（PTH）调节的钙重吸收
B. 抑制胰岛素的分泌，升高血糖
C. 减少组织利用葡萄糖，升高胆固醇和低密度脂蛋白
D. 使血液浓缩，血浆渗透压增高，加重肾损害
E. 抑制钙的重吸收

正确答案：A。促进远曲小管由甲状旁腺激素（PTH）调节的钙重吸收

解析：该患者目前不宜使用噻嗪类利尿剂降压的主要原因是促进远曲小管由甲状旁腺激素（PTH）调节的钙重吸收（A对）。依据本题中患者的实验室检查血钙3.2mmol/L（正常值2.25～2.75mmol/L），血钾5.0mmol/L（正常值3.5～5.5mmol/L），血肌酐100μmol/L（正常值44～133μmol/L），血糖6.1mmol/L（正常值3.9～6.1mmol/L），血低密度脂蛋白2.3mmol/L（正常值＜3.12mmol/L）。可见该患者的血钙浓度已经高于正常值，噻嗪类利尿剂促进远曲小管由甲状旁腺激素（PTH）调节的钙重吸收（A对E错），将会使血钙升高，不宜使用。而其他指标尚且正常抑制胰岛素的分泌，升高血糖（B错），减少组织利用葡萄糖，升高胆固醇和低密度脂蛋白（C错），使血液浓缩，血浆渗透压增高，加重肾损害（D错）并非不宜使用噻嗪类利尿剂降压的主要原因。